在牙槽骨受压侧的骨吸收陷窝，表现为蚕食状凹陷，称为
A. 穿通纤维
B. Howship陷窝
C. 骨间板
D. 哈弗系统
E. 束骨

正确答案：B。Howship陷窝

解析：牙槽骨的改建是通过骨的形成和吸收来完成的。在骨吸收区，骨表面有蚕食状凹陷，称Howship陷窝。掌握“牙槽骨”知识点。